女，35岁。突然听到丈夫在车祸中去世的消息，表现为不认识亲人，凭空看到丈夫就站在自己面前，说“我给你做饭吧”，随即进厨房做饭，家人劝阻也不理踩，两天后突然清醒，对病情经过不能完全回忆。该患者的状态是
A. 幻觉妄想状态
B. 抑郁状态
C. 朦胧状态
D. 谵妄状态
E. 强迫状态

正确答案：C。朦胧状态

解析：中年女性患者，在急性应激事件后，“看到丈夫，并为其做饭，无视家人”等幻视，周边事务不能正常感知，两天后突然清醒，事后部分遗忘。易诊断为朦胧状态（C对）。谵妄状态（D错）的幻觉和错觉以形象鲜明的恐怖性幻视和错视为主，如猛兽、毒蛇等。幻觉妄想状态（A错）以被害妄想及评论性幻听为主。